卵巢分泌的激素是
A. 催乳素
B. 促黄体生成素
C. 卵泡刺激素
D. HCG
E. 孕激素

正确答案：E。孕激素

解析：卵巢可以分泌孕激素（E对）。（P413）催乳素（PRL）是腺垂体催乳素细胞分泌的一种多肽蛋白激素（A错）。（P27）腺垂体的促性腺激素细胞分泌卵泡刺激素 （FSH）和黄体生成素（LH） （BC错）。（P416）人绒毛膜促性腺激素（hCG）是一种糖蛋白激素…主要由妊娠滋养细胞产生，妊娠、妊娠滋养细胞疾病、生殖细胞肿瘤及其他恶性肿瘤如肺、肾上腺及肝脏肿瘤均可产生hCG（D错）。